色谱法常用术语中，Wh/2代表的量是
A. 分配系数
B. 容量因子
C. 保留时间
D. 峰宽
E. 半高峰宽

正确答案：E。半高峰宽

解析：本题考查色谱法。色谱法常用术语中，Wh/2代表的量是半高峰宽（E对）。峰高一半处的峰宽称为半高峰宽，用Wh/2表示。分配系数（A错）用K表示。容量因子（B错）用k´表示。保留时间（C错）用tR表示。峰宽（D错）用W表示。